男，57岁，体检发现血糖升高。既往有高血压、高脂血症史。其母患糖尿病。查体。BP160/100mmHg，身高175cm，体重90kg。双肺听诊未见异常。心率76次/分，律齐，肝脾肋下未触及，实验室检查：空腹血糖7.8mmol/L，HbAlc8.0%。该患者首选的降糖治疗药物是
A. 吡格列酮
B. 格列齐特
C. 二甲双胍
D. 西格列汀
E. 阿卡波糖

正确答案：C。二甲双胍

解析：中年男性患者，既往有高血压、高脂血症，有家族遗传糖尿病病史，空腹血糖7.8mmol/L（3.9～6.1mmol/L），HbAlc8.0%（正常值4%～6%），考虑诊断为2型糖尿病。患者体型肥胖，BMI=29.4（BMI=体重kg÷身高m²，BMI＜18.5为偏瘦，18.5～23.9为正常体型，24.0～27.9为超重，≥28为肥胖），二甲双胍不增加体重，并可改善血脂谱、增加纤溶系统活性、降低血小板聚集性、使动脉壁平滑肌细胞和成纤维细胞生长受限等，被认为可能有助于缓解或改善糖尿病血管并发症，其不良反应较少，尤其适用于肥胖患者，目前为我国2型糖尿病药物治疗的一线用药，因此本例药物治疗首选二甲双胍（C对）。吡格列酮（A错）属于格列酮类（噻唑烷二酮类），适用于T2DM，尤其是肥胖、胰岛素抵抗明显者，但是常有体重增加和水肿的副作用。格列齐特（B错）属于磺酰脲类，适用于新诊断的T2DM非肥胖患者、用饮食和运动治疗血糖控制不理想时。西格列汀（D错）是二肽基肽酶4（DPP-4）抑制剂，单独使用不增加低血糖发生的风险，也不增加体重，单药使用或与二甲双胍联合应用治疗T2DM，由于价格昂贵，故不作为一线降糖药。阿卡波糖（E错）属于α葡萄糖苷酶抑制剂（AGI），适用于以碳水化合物为主要食物成分，或空腹血糖正常（或不太高）而餐后血糖明显升高者。